下列药物中可用于预防偏头痛发作的是
A. 麦角氨咖啡因
B. 地西泮
C. 甲灭酸
D. 普萘洛尔
E. 舒马曲普坦

正确答案：D。普萘洛尔

解析：可用于预防偏头痛发作的是β受体阻滞剂、钙离子通道阻滞剂、抗癫痫剂和抗抑郁剂，β受体阻滞剂中证据最为充足的是普萘洛尔（D对）和美托洛尔，钙离子通道阻滞剂中仅氟桂利嗪的证据充足。抗癫痫药中以丙戊酸和托吡酯的证据充足。抗癫痫药地西泮（B错）不用于预防偏头痛发作。唯一在所有研究中均被证实有效的抗抑郁剂是阿米替林。麦角氨咖啡因（A错）主要用于偏头痛的治疗，能减轻其症状，但无预防和根治作用，只宜头痛发作时短期使用。甲灭酸（C错）是一种口服的抗炎药。舒马曲普坦（E错）用于成人有先兆或无先兆偏头痛急性发作的治疗。